可作为栓剂水溶性基质的是
A. 巴西棕榈蜡
B. 尿素
C. 甘油明胶
D. 叔丁基羟基茴香醚
E. 羟苯乙酯

正确答案：C。甘油明胶

解析：本题考查栓剂的基质。甘油明胶（C对）可作为栓剂的水溶性基质；巴西棕榈蜡（A错）可作为栓剂的硬化剂；尿素（B错）可作为助溶剂；叔丁基羟基茴香醚（D错）可用作栓剂的抗氧化剂；羟苯乙酯（E错）可用作栓剂的防腐剂。